易产生心脏毒性的抗心力衰竭药
A. 米力农
B. 地高辛
C. 依那普利
D. 硝酸甘油
E. 氢氯噻嗪

正确答案：B。地高辛

解析：本题考查地高辛。易产生心脏毒性的抗心力衰竭药是地高辛（B对）。地高辛属于洋地黄类药物，洋地黄用药安全窗很小，轻度中毒剂量约为有效治疗剂量的两倍，心肌在缺血缺氧情况下中毒剂量更小。米力农（A错）为磷酸二脂酶抑制剂，副作用少。依那普利（C错）为血管紧张素转换酶抑制剂，用于治疗高血压型心衰。硝酸甘油（D错）用于心绞痛治疗，易产生耐受性。氢氯噻嗪（E错）为利尿剂，临床用于高血压治疗。